注射用乳剂可选用的乳化剂为
A. 司盘80
B. 月桂醇硫酸钠
C. 洁尔灭
D. 卵磷脂
E. 十二烷基苯磺酸钠

正确答案：D。卵磷脂

解析：本题考查常用的表面活性剂。注射用乳剂可选用的乳化剂为卵磷脂（D对）。两性离子型表面活性剂卵磷脂：卵磷脂是天然的两性离子型表面活性剂，是由磷酸型的阴离子部分和季铵盐型的阳离子部分所组成。目前是制备注射用乳剂的主要附加剂。非离子型表面活性剂脂肪酸山梨坦类：为脱水山梨醇脂肪酸酯类，是由山梨醇与各种不同的脂肪酸所组成的酯类化合物，商品名为司盘。油酸山梨坦（司盘80（A错））是单油酸酯其HLB值在4.3～8.6之间，亲油性较强，为油溶性，故一般用作W/O型乳剂的乳化剂或O/W型乳剂的辅助乳化剂。阴离子表面活性剂硫酸化物：系硫酸化油和高级脂肪醇硫酸酯类，通式为R·O·SO⁻₃M⁺，其中脂肪烃链R在C₁₂～C₁₈之间。高级脂肪醇硫酸酯类中常用的是十二烷基硫酸钠（月桂醇硫酸钠（B错））、十六烷基硫酸钠（鲸蜡醇硫酸钠）、十八烷基硫酸钠（硬脂醇硫酸钠）等。乳化性较强，且较肥皂类稳定，主要用作外用软膏的乳化剂。阳离子型表面活性剂苯扎氯铵和苯扎溴铵：苯扎氯铵（商品名为洁尔灭（C错））和苯扎溴铵（商品名为新洁尔灭）均为白色或淡黄色粉末或胶状体，具有杀菌、渗透、清洁、乳化等作用。新洁尔灭杀菌力很大，穿透性强，毒性较低。主要用作杀菌防腐剂。阴离子型表面活性剂磺酸化物：系指脂肪族磺酸化物、烷基芳基磺酸化物和烷基萘磺酸化物等，通式为R·SO⁻₃M⁺。脂肪族磺酸化物如二辛基琥珀酸磺酸钠（商品名阿洛索-OT）、二己基琥珀酸磺酸钠（商品名阿洛索-18），烷基芳基磺酸化物如十二烷基苯磺酸钠（E错），均为目前广泛应用的洗涤剂。